治疗淤血证，肠痈，咳嗽气喘，应首选的药物是
A. 丹参
B. 桃仁
C. 川芎
D. 益母草
E. 延胡索

正确答案：B。桃仁

解析：本题主要考查活血化瘀药的鉴别应用。桃仁具有活血祛瘀，润肠通便，止咳平喘的功效。可用于瘀血证，肠痈，咳嗽气喘等证（B对）。丹参具有活血调经，祛瘀止痛，凉血消痈，除烦安神的功效，可用于月经不调，闭经痛经，产后瘀滞腹痛；血瘀心痛，脘腹疼痛，癥瘕积聚，跌打损伤，风湿痹证；疮痈肿毒；热病烦躁神昏，心悸失眠（A错）。川芎（血中之气药）具有活血行气，祛风止痛的功效，可用于血瘀气滞痛证；头痛，风湿痹痛（C错）。益母草具有活血调经，利水消肿，清热解毒的功效，可用于血滞经闭、痛经、经行不畅、产后恶露不尽、瘀滞腹痛；水肿，小便不利；跌打损伤，疮疡肿毒，皮肤瘾疹（D错）。延胡索具有活血，行气，止痛的功效。可用于气血瘀滞痛症（E错）。